患者女，48岁，胸痛部位在乳头外，刺痛，发作数秒钟，含硝酸甘油1～2秒疼痛即消失，应首先考虑的诊断是
A. 稳定型心绞痛
B. 肋间神经痛
C. 心绞痛不典型
D. 心脏神经官能症
E. 变异型心绞痛

正确答案：D。心脏神经官能症

解析：患者发生胸痛，数秒钟，含硝酸甘油1～2秒疼痛即消失，是心脏神经官能症的症状，故应先考虑的诊断是心脏神经官能症（D对）。稳定型心绞痛是由于劳力引起心肌缺血，导致胸部及附近部位的不适，可伴心功能障碍，但没有心肌坏死。其特点为前胸阵发性的压榨性窒息样感觉，主要位于胸骨后，可放射至心前区和左上肢尺侧面，也可放射至右臂和两臂的外侧面或颈与下颌部，持续数分钟，往往经休息或舌下含服硝酸甘油后迅速消失（A错）。肋间神经痛是指一个或几个肋间部位从背部沿肋间向胸腹前壁放射，呈半环状分布。多为单侧受累，也可以双侧同时受累。咳嗽、深呼吸或打喷嚏往往使疼痛加重（B错）。心绞痛不典型表现为疼痛时间长，超过30分钟，疼痛不典型表现为肚子痛（尤其是上腹部疼痛）、左边肩膀疼痛，少数还可以表现为咽喉痛、牙痛等，但多数同时伴有前胸发闷或闷痛。无症状心肌缺血，疼痛性质改变（C错）。变异型心绞痛的发作与活动无关，疼痛发生在安静时，发作时心电图ST段抬高，发作过后ST段下降，不出现病理Q波（E错）。